关于平衡十定律描述哪项是错误的
A. 髁导斜度增加，补偿曲线曲度也增加
B. 髁导斜度增加，定位平面斜度也增加
C. 髁导斜度增加，切导斜度也增加
D. 髁导斜度增加，牙尖斜度也增加
E. 补偿曲线曲度增加，切导斜度也增加

正确答案：C。髁导斜度增加，切导斜度也增加

解析：本题考查平衡（牙合）的理论。髁导斜度和切导斜度间为反变关系，故髁导斜度增加，切导斜度应减小（C错，为本题正确答案）。髁导斜度或切导斜度与其余任何一因素都是正变关系，即髁导斜度增加，补偿曲线曲度也增加（A对），定位平面斜度也增加（B对），牙尖斜度也增加（D对）；补偿曲线曲度增加，切导斜度也增加（E对）。